负责对定点零售药店处方外配服务情况进行检查和费用审核的是
A. 劳动保障行政部门
B. 药品监督管理部门
C. 卫生行政部门
D. 社会保险经办机构
E. 工商行政管理部门

正确答案：D。社会保险经办机构